临床治疗药物检测的前提是体内药物浓度的准确测定，在体内药物浓度测定中，如果抗凝剂、防腐剂可能与被测的药物发生作用，并对药物浓度的测定产生干扰，则检测样品宜选择
A. 汗液
B. 尿液
C. 全血
D. 血浆
E. 血清

正确答案：E。血清

解析：本题考查体内药物检测。药物与血浆纤维蛋白几乎不结合，在通常情况下，血浆与血清中药物的浓度相近。如果抗凝剂与药物可能发生作用，并对药物浓度测定产生干扰，则以血清（E对）为检测样本。汗液（A错）一般不作为检测样品；尿液低温保存需要加入防腐剂后冷藏保存，如果防腐剂可能与被测的药物发生作用，并对药物浓度的测定产生干扰，不宜用尿液（B错）；全血（C错）采集后置含有抗凝剂的试管中；将采集的全血置含抗凝剂的试管中，混合均匀，即得血浆（D错）。